风疹隔离至出疹后
A. 15天
B. 10天
C. 5天
D. 21天
E. 8天

正确答案：C。5天

解析：风疹患者应隔离至出疹后5天（C对），易感者接触隔离21天（D错）。麻疹患者应隔离至出疹后5天，若并发肺炎，则隔离至出疹后10天。